具有“发中有补，散中有收，邪正兼顾，阴阳并调”配伍特点的方剂是
A. 桂枝汤
B. 麻黄汤
C. 止嗽散
D. 小青龙汤
E. 九味羌活汤

正确答案：A。桂枝汤

解析：桂枝汤中桂枝为君，助卫阳，通经络，解肌发表而祛在表之风邪；芍药为臣，益阴敛营，敛固外泄之营阴。桂芍等量合用，为本方外可解肌发表，内调营卫、阴阳的基本结构，其具体寓意有三：一为针对卫强营弱，体现营卫同治，邪正兼顾；二为相制相成，散中有收，汗中寓补；三为相辅相成，桂枝得芍药，使汗而有源，芍药得桂枝，则滋而能化。另生姜辛温，助桂枝辛散表邪；大枣甘平，益气补中、滋脾生津；炙甘草调和药性。故本方为发中有补，散中有收，邪正兼顾，阴阳并调（A对）。麻黄汤的配伍特点有二：一为麻、桂相须，开腠畅营，则发汗解表之功益彰；二为麻、杏相使，宣降相因，则宣肺平喘之效甚著（B错）。止嗽散具有温而不燥、润而不腻、散寒不助热、解表不伤正的特点（C错）。小青龙汤散中有收，开中有合，使风寒解，水饮去，宣降复，则诸症自平（D错）。九味羌活汤既能统治风寒湿邪，又能兼顾协调表里，共成发汗祛湿、兼清里热之剂（E错）。